某男，28岁，2天前感冒，症见发热恶寒，头痛，鼻塞，项背强痛，舌苔薄白，脉浮。医师辨证组方时，为了减轻项背强痛的症状，宜选用的药物是
A. 葛根
B. 白芷
C. 藁本
D. 桂枝
E. 羌活

正确答案：A。葛根

解析：本题考查的是葛根的主治病证。医师辨证组方时，为了减轻项背强痛的症状，宜选用的药物是葛根（A对）。葛根：【主治病证】（1）外感表证，项背强痛。（2）麻疹初起透发不畅。（3）热病烦渴，消渴证。（4）湿热泻痢初起，脾虚泄泻。白芷（B错）：【主治病证】（1）外感风寒或表证夹湿兼见头痛鼻塞者。（2）阳明头痛，眉棱骨痛，鼻渊头痛，牙痛。（3）风寒湿痹，寒湿带下。（4）疮疡肿毒。藁本（C错）：【主治病证】（1）风寒表证，表证夹湿，颠顶头痛。（2）风寒湿痹。桂枝（D错）：【主治病证】（1）风寒表虚有汗，风寒表实无汗。（2）风寒湿痹，经寒血滞之月经不调、痛经、闭经，癥瘕。（3）胸痹作痛，阳虚心悸。（4）虚寒腹痛。（5）阳虚水肿，痰饮证。羌活（E错）：【主治病证】（1）风寒表证，表证夹湿，太阳头痛。（2）风寒湿痹。